眶下孔位于眶下缘中点下方约
A. 0.05cm
B. 0.5cm
C. 1.0cm
D. 1.5cm
E. 2.0cm

正确答案：B。0.5cm

解析：上颌体前外面有眶下孔、尖牙窝，眶下孔位于眶下缘中点下方约0.5cm处，孔内有眶下神经、血管通过，是眶下神经阻滞麻醉的有效注射部位，眶下孔向后、上、外方通入眶下管，尖牙窝一般位于前磨牙根尖的上方。掌握“面部表面解剖”知识点。